男，58岁。活动后呼吸困难半年。心率85次/分，P₂＞A₂，胸部X线片示右下肺动脉直径1.8cm，双下肺纹理增粗紊乱。为明确诊断，应首先进行的检查是
A. 肺功能
B. 血气分析
C. 胸部高分辨CT
D. 超声心动图
E. 支气管镜

正确答案：D。超声心动图

解析：患者活动后呼吸困难半年，心率正常，P₂＞A₂（为肺动脉高压的典型表现），胸片X线显示右下肺动脉直径1.8cm（右下肺动脉干扩张，其横径≥15mm或右下肺动脉横径与气管横径比值≥1.07，或动态观察右下肺动脉干增宽＞2mm），根据其临床表现和辅助检查，可以诊断为肺动脉高压症，在肺动脉高压症的基础上，心电图、X线、超声心动图有肺动脉增宽和右心增大、肥厚的征象，才可以做出肺心病的诊断（D对）。肺功能（A错）检查是呼吸系统疾病的必要检查之一，对于早期检查出肺、气道病变，评估疾病的严重程度及预后，鉴别呼吸困难的病因等有重要意义，但是不能用来诊断肺心病。血气分析（B错）是对血液中的酸碱度，二氧化碳分压和氧分压等相关指标进行测定，常用于判断机体是否存在酸碱平衡失调及缺氧程度等。胸部高分辨率CT（C错）常用于肺癌，特发性肺纤维化等肺部疾病诊断。支气管镜（E错）检查常用于肺癌的定性诊断，支气管扩张、肺结核和间质性肺疾病的辅助诊断。